关于冠延长术手术内容的叙述不正确的是
A. 翻瓣术结合骨切除术
B. 切除部分牙龈和牙槽骨
C. 只切除牙龈不切除牙槽骨
D. 牙根过短不能做冠延长术
E. 牙折达到龈下，影响修复者需做冠延长术

正确答案：C。只切除牙龈不切除牙槽骨

解析：冠延长术适用于牙体折裂，并影响修复或者治疗的情况。其手术中需要进行翻瓣，并除去被切除的牙龈，暴露根面或牙根断面以及骨修整，切除部分支持骨，使骨嵴高度位置能满足术后生物学宽度的需要，骨嵴顶需降至牙断缘根方至少3mm处。在骨修整时，还需注意使该处的骨嵴高度与其他部位及邻牙的骨嵴逐渐移行，避免明显的悬殊，从而在术后获得良好的牙龈外形。掌握“牙周健康与修复”知识点。